男孩，5岁。水肿伴尿少3天。病前2天有“上感”史。查体：BP90/60mmHg，眼睑及颜面水肿，双下肢凹陷性水肿。实验室检查：血浆白蛋白22g/L，胆固醇7.2mmol/L，肾功能正常，血C31.25g/L，PPD试验（-）。尿常规：RBC10/HP，蛋白（++++）。首选的治疗药物是
A. 泼尼松
B. 青霉素
C. 环孢素A
D. 甲泼尼龙
E. 雷公藤多苷

正确答案：A。泼尼松

解析：患者儿童，有上感病史，水肿伴尿少，低蛋白血症，大量蛋白尿，高脂血症，肾功能正常，血C3正常，大量蛋白尿，这些症状符合肾病综合征表现。泼尼松是治疗肾病综合征最常用的药物，因此该患儿首选的治疗药物是泼尼松（A对）。青霉素可以用于肾病综合征并发肺炎链球菌感染时的治疗，但是该患儿并没有相关感染表现，因此不用青霉素治疗（B错）。环孢素A（C错）和雷公藤多苷（E错）都是免疫抑制剂，主要用于治疗肾病综合征频繁复发，糖皮质激素依赖、耐药或严重副作用者，不是首选的治疗药物。甲泼尼龙主要用于治疗泼尼松疗效较差的病例，不是首选的治疗药物（D错）。